患者，女性，29岁，近3个月来刷牙、咀嚼硬物时牙龈易出血，牙龈长一肿瘤2个月，并慢慢长大，影响进食。检查：多数龈缘及龈乳头鲜红色，松软发亮。下切牙唇侧有一瘤状增生物。确诊前最应询问的病史为
A. 刷牙史
B. 牙签剔牙史
C. 食物嵌塞史
D. 服消炎药史
E. 妊娠史

正确答案：E。妊娠史

解析：本题考查妊娠期龈瘤的诊断。患者女性，29岁（育龄期），牙龈易出血，牙龈肿瘤2个月影响进食。龈缘及龈乳头鲜红色松软发亮。下切牙唇侧有一瘤状增生物，综合考虑怀疑为妊娠期龈瘤，确诊前最应询问的病史为妊娠史（E对）。育龄期妇女牙龈出现鲜红色，高度水肿且有明显出血倾向者，或有瘤样表征的患者，应询问其月经情况，了解是否妊娠。在本病例中，刷牙史（A错）、牙签剔牙史（B错）、食物嵌塞史（C错）、服消炎药史（D错）均不是重点询问项目。